女，33岁。反复便秘、腹痛10年。便前腹痛、腹部不适，便后缓解；工作紧张时症状加重。无便血及消瘦。睡眠差。最有可能的诊断是
A. 克罗恩病
B. 肠易激综合征
C. 肠结核
D. 结肠癌
E. 溃疡性结肠炎

正确答案：B。肠易激综合征

解析：青年女性，腹部不适10年（超过6个月），便后不适可缓解；腹部不适与精神等因素相关（肠易激综合征常见症状特点），无明确相关形态学改变和生化异常（肠易激综合征多无器质性改变）。结合上述病史和临床表现，最有可能的诊断是肠易激综合征（B对）。克罗恩病（A错）、肠结核（C错）、结肠癌（D错）和溃疡性结肠炎（E错）一般有便血或消瘦等警报症状（提示器质性疾病），病情变化与情绪无关。